慢性骨髓炎的治疗原则不包括
A. 摘除死骨
B. 清除疤痕和肉芽
C. 消灭死腔
D. 改善局部血液循环
E. 切除新生包壳

正确答案：E。切除新生包壳

解析：慢性骨髓炎的治疗原则包括摘除死骨（A对）、清除瘢痕和肉芽（B对）及消灭死腔（C对）。过早取掉大块死骨会造成长段骨缺损，须待包壳生成后再行手术，故切除新生包壳（E错，为本题正确答案），不利于该病的预后。改善局部血液循环（D对）可增强局部组织的修复能力与抵抗力，为一般性治疗措施。